下列哪一项肌肉的起始处在尖牙窝上
A. 颊肌
B. 提上唇肌
C. 提口角肌
D. 提上唇鼻翼肌
E. 腭帆提肌

正确答案：C。提口角肌

解析：上颌骨上颌体前外面有眶下孔、尖牙窝，眶下孔位于眶下缘中点下方约0.5cm处，孔内有眶下神经、血管通过，是眶下神经阻滞麻醉的有效注射部位，眶下孔向后、上、外方通入眶下管，尖牙窝一般位于前磨牙根尖的上方，为提口角肌起始处。掌握“上颌骨解剖特点”知识点。